袢利尿剂是利尿作用最强的一类利尿剂，属于袢利尿剂的药物是
A. 氢氯噻嗪
B. 布美他尼
C. 乙酰唑胺
D. 阿米洛利
E. 吲达帕胺

正确答案：B。布美他尼

解析：本题考查袢利尿剂。属于袢利尿剂的药物是布美他尼（B对）。利尿药是作用于肾脏，能增加电解质特别是Na⁺和水的排出，使尿量增加的药物。该类药物通过作用于肾单位不同部位而产生利尿作用。利尿药常按利尿作用、部位分为5类，即袢利尿药（高效能利尿药）、噻嗪类与类噻嗪类利尿药（中效能利尿药）、留钾利尿药（低效能利尿药）和碳酸酐酶抑制药与渗透性利尿药（又称脱水药）。袢利尿剂为高效能利尿剂，其主要作用于髓袢升支粗段，利尿作用强，代表药物有呋塞米、布美他尼和依他尼酸等。通过抑制髓袢升支管腔膜侧的Na⁺-K⁺-2Cl⁻同向转运子，从而抑制NaCl的重吸收，降低肾的稀释与浓缩功能，排出大量接近于等渗的尿液。氢氯噻嗪（A错）是噻嗪类利尿剂，主要用于水肿性疾病，轻型尿崩症，高血压。乙酰唑胺（C错）为碳酸酐酶抑制剂，临床用于治疗各种类型的青光眼及继发性青光眼降低眼压。阿米洛利（D错）均为留钾利尿药，抑制远曲小管和集合管Na⁺重吸收，抑制K⁺分泌，对切除肾上腺的动物仍有效，主要与排钾利尿药合用于治疗顽固性水肿。吲达帕胺（E错）为类噻嗪类利尿药，具有血管扩张作用，降压疗效与常规剂量的氨氯地平相同，对收缩压和舒张压均有降低作用，疗效强于氢氯噻嗪，用于轻重度高血压。